评价医德行为善恶的根本标准是
A. 病人的意见
B. 病人家属的意见
C. 新闻媒体的认定
D. 有利于病人、有利于医学发展、有利于生存环境的改善
E. 社会主义医德规范体系

正确答案：D。有利于病人、有利于医学发展、有利于生存环境的改善

解析：医德评价是医务人员人际关系的“调节器”，也是维护医德原则和规范的重要保障，并且是使医德原则和规范转化为医务人员行为的中介和桥梁。掌握“医学道德评价”知识点。